对麻疹前驱期诊断极有帮助的是
A. 低中度发热
B. Koplik斑
C. Pastia
D. 皮疹
E. 草莓舌

正确答案：B。Koplik斑